旋转推进法整复
A. 单侧完全唇裂
B. 双侧不完全唇裂
C. 不完全腭裂
D. 双侧完全腭裂
E. 单侧完全腭裂

正确答案：A。单侧完全唇裂

解析：本题考查唇腭裂的整复方法。旋转推进法整复单侧完全唇裂（A对）。旋转推进法为Miard首先提出，其特点是手术原理简单易懂，建立了以矫正组织移位为目标的手术原则，术中切除组织少，术后裂侧唇部中下份的瘢痕线模拟了裂侧人中嘴形态，唇弓形态恢复自然，为单侧唇裂整复术。双侧不完全唇裂（B错）用前唇原长法整复。腭裂（CDE错）多采用提肌重建手术，腭咽成形术等术式。